主纳气之脏是
A. 肾
B. 脾
C. 肺
D. 肝
E. 心

正确答案：A。肾

解析：肾主纳气（A对），是指肾具有摄纳肺吸入的清气而维持正常呼吸的功能。肾气摄纳肺所吸入的自然界清气，保持吸气的深度，防止呼吸表浅。肺司呼吸，呼气赖肺气宣发，吸气赖肺气肃降。但吸气维持一定的深度，除肺气肃降作用外，还有赖于肾气的摄纳潜藏。脾的生理功能有脾主运化、脾主统血（B错）。肺的生理功能有肺主气司呼吸、肺主通调水道、肺朝百脉（C错）。肝的生理功能有肝主疏泄、肝主藏血（D错）。心的生理功能有心主血脉、心主神明（E错）。